患者有轻度液体潴留，半高血压而肾功能正常的心力衰竭患者，应选用的利尿剂是
A. 卡维地洛
B. 氢氯噻嗪
C. 呋塞米
D. 比索洛尔
E. 地高辛

正确答案：B。氢氯噻嗪

解析：本题考查利尿药。氢氯噻嗪（B对）为噻嗪类利尿剂，直接抑制远曲小管初段腔壁上Na⁺-Cl⁻共转运子，减少肾小管上皮细胞对Na⁺、Cl⁻和水的排出，发挥利尿作用，临床也可用于高血压的治疗，仅适用于有轻度液体潴留、伴有高血压而肾功能正常的患者。呋塞米（C错）作为袢利尿剂，作用于髓袢升支粗段，抑制Na⁺-K⁺-2Cl⁻协转运体，使NaCl重吸收减少，影响肾的稀释与浓缩功能，发挥利尿作用。与其它利尿药相比，其利尿作用最强，为明显液体潴留心力衰竭的首选治疗药。比索洛尔（D错）和地高辛（E错）均为抗心力衰竭药。卡维地洛（A错）为α、β受体阻断剂，阻断受体的同时具有舒张血管作用，用于治疗轻度及中度高血压或伴有肾功能不全、糖尿病的高血压患者。